镜下见细胞排列成管状、筛状和实性结构的肿瘤是
A. 多形性低度恶性腺癌
B. 腺样囊性癌
C. 恶性多形性腺癌
D. 黏液表皮样癌
E. 腺泡细胞癌

正确答案：B。腺样囊性癌

解析：本题考查腺样囊性癌。镜下见细胞排列成管状、筛状和实性结构的肿瘤是腺样囊性癌（B对）。1.腺样囊性癌又称为圆柱瘤，是一种基底细胞样肿瘤，它由上皮细胞和肌上皮细胞排列成管状、筛状和实性巢等不同的形态结构。2.细胞形态一致性、组织结构多样性及浸润性生长的是多形性低度恶性腺癌（A错）。3.恶性多形性腺瘤（C错）是与良性多形性腺瘤相对应的恶性肿瘤，其发病率占唾液腺上皮性肿瘤的2%～6%。分为三种类型：多形性腺瘤癌变、癌肉瘤和转移性多形性腺瘤。其中，最常见的是多形性腺瘤癌变，以良性多形性腺瘤上皮成分的恶性转化为特征；癌肉瘤是一种少见的“混合性”肿瘤，含有癌和肉瘤两种成分；转移性多形性腺瘤其组织学特征不能同良性多形性腺瘤相区分，即使转移光镜下转移灶也呈良性表现，相似于原发灶。4.黏液表皮样癌（D错）是由黏液细胞、中间细胞和表皮样细胞构成的恶性唾液腺上皮性肿瘤，可伴有柱状细胞、透明细胞和嗜酸细胞形态特征。5.腺泡细胞癌（E错）根据肿瘤细胞类型和排列方式，分为以下四种组织类型：实体型、微囊型、滤泡型和乳头囊状型。